外潜伏期是指
A. 自病原体侵入机体至最早出现临床症状的这段时间
B. 病原体侵入吸血节肢动物体内至使吸血节肢动物具有感染性的这段时间
C. 病原体不断更替宿主的过程
D. 病原体从传染源排出至侵入新的易感宿主之前的这段时间
E. 自病原体侵入机体至具有感染力的这段时间

正确答案：B。病原体侵入吸血节肢动物体内至使吸血节肢动物具有感染性的这段时间